与社区卫生服务无关的选项是
A. 服务范围有个人、家庭、社区
B. 服务内容涉及生理、心理、社会文化各方面
C. 服务对象包括病人和非病人
D. 服务重点是卫生宣教
E. 服务方式是预防、治疗和康复相结合

正确答案：D。服务重点是卫生宣教

解析：本题考查社区卫生服务的相关内容。社区卫生服务的服务范围有个人、家庭、社区（A对）；社区卫生服务的服务内容涉及生理、心理、社会文化各方面（B对）；社区卫生服务的服务对象包括病人和非病人（C对）；社区卫生服务服务的重点是妇女、儿童、老年人、慢性病人、残疾人等（D错，为本题正确答案）；社区卫生服务的服务方式是预防、治疗和康复相结合（E对）。